根据《中药品种保护条例》，从天然药物中提取的有效物质，申请中药保护品种的保护期限和延长的保护期限分别为
A. 10年、10年
B. 10年、20年
C. 10年、14年
D. 7年、7年
E. 7年、10年

正确答案：D。7年、7年

解析：本题考查中药保护品种的等级划分和保护措施。根据《中药品种保护条例》，从天然药物中提取的有效物质，申请中药保护品种的保护期限和延长的保护期限分别为7年、7年（D对）。申请中药二级保护品种应具备的条件：符合下列条件之一的中药品种，可以申请二级保护。①符合上述一级保护的品种或者已经解除一级保护的品种；②对特定疾病有显著疗效的；③从天然药物中提取的有效物质及特殊制剂。中药一级保护品种的保护期限分别为30年、20年、10年，中药二级保护品种的保护期限为7年。中药二级保护品种在保护期满后可以延长保护期限，时间为7年，由生产企业在该品种保护期满前6个月，依据条例规定的程序申报。